关于心与志、液、体、华、窍的关系，正确的是
A. 在志为喜
B. 在液为血
C. 在体为脉
D. 在华为发
E. 在窍为舌

正确答案：A、C、E。在志为喜；在体为脉；在窍为舌

解析：本题考查的是心与志、液、体、华、窍的关系。心在志为喜（A对）、在体合脉（C对）、在窍为舌（E对）。心与志、液、体、华、窍的关系：1.心在志为喜；2.心在液为汗；3.心在体合脉，其华在面；4.心在窍为舌。在液为血（B错），五脏在液均不为血。心在液为汗、肺在液为涕、脾在液为涎、肝在液为泪、肾在液为唾。在华为发（D错）的是肾。肾与志、液、体、华、窍的关系：1.肾在志为恐；2.肾在液为唾；3.肾在体合骨，其华在发；4.肾在窍为耳及二阴。